治疗外感表证兼有食积者，宜选用的药物是
A. 神曲
B. 麦芽
C. 青皮
D. 莪术
E. 山楂

正确答案：A。神曲

解析：该题考查神曲的主治病证。神曲主治饮食积滞，尤略有解表退热之功效，尤适用于外感表证兼食积者（A对）。麦芽主治淀粉性食物引起的食积（B错）。青皮主治食积腹痛（C错）。莪术主治食积脘腹胀痛（D错）。山楂主治肉食积滞（E错）。